扩散的前提条件是
A. 外源化学物具有脂溶性
B. 浓度梯度
C. 有载体
D. 有能量供应

正确答案：B。浓度梯度

解析：本题考查扩散的前提条件。简单扩散又称脂溶扩散，是大多数化学毒物通过生物膜的方式。扩散的前提条件是浓度梯度（B对ACD错），生物膜两侧的浓度梯度对于扩散速率的影响最为重要。